肝区病变出现腹痛的特点是
A. 突发中上腹剧烈刀割样持续性疼痛
B. 持续性、广泛性剧烈腹痛伴腹肌紧张
C. 右上腹进行性锐痛
D. 剑突下钻顶样疼痛
E. 右上腹阵发性绞痛

正确答案：C。右上腹进行性锐痛

解析：肝区病变出现腹痛的特点是右上腹进行性锐痛（C对）。突发中上腹剧烈刀割样持续性疼痛（A错）多见于胃、十二指肠溃疡穿孔。持续性、广泛性剧烈腹痛伴腹肌紧张（B错）多见于急性弥漫性腹膜炎。剑突下钻顶样疼痛（D错）多见于胆道蛔虫症。右上腹阵发性绞痛（E错）多见于胆囊炎。